喝牛奶后出现腹痛、腹泻等症状可改用
A. 酸奶
B. 脱脂奶
C. 奶粉
D. 甜炼乳
E. 淡炼乳

正确答案：A。酸奶